急性多发性龈脓肿最佳治疗方案为
A. 局部治疗配合抗生素治疗
B. 洗必泰液含漱1周后配合局部治疗
C. 2%H₂O₂含漱1周，再作局部治疗
D. 局部治疗配合中西医结合疗法
E. 局部治疗配合支持疗法

正确答案：D。局部治疗配合中西医结合疗法

解析：本题考查急性多发性龈脓肿的治疗。急性多发性龈脓肿是一种比较少见的临床症状较重的牙龈急性炎症，局限于龈乳头，主要发生于青壮年男性。治疗方案为：1.全身应用抗生素治疗效果常不明显，病程可长达数周。中西医结合治疗的效果良好。2.局部清洗、洗牙、引流为辅，避免过多刺激。脓肿刚发生时可用1%～3%过氧化氢液或0.12%～0.2%氯己定冲洗龈袋。脓肿形成后应及时切开引流，并给予漱口液含漱。联合治疗常能取得较良好的效果，局部治疗配合中西医结合疗法（D对）的效果优于单纯用抗生素者和局部治疗配合抗生素治疗（A错）者。3.急性症状控制后，应进行彻底的牙周局部治疗，消除炎症，防止复发。而局部治疗配合支持疗法（E错）的治疗方案，治疗效果缓慢且不能针对病因快速有效抑制急性多发性龈脓肿的急性炎症，不属于最佳治疗方案。对于漱口液如洗必泰（B错）、2%H₂O₂（C错）含漱1周后再进行局部治疗的治疗方案，急性多发性龈脓肿临床症状较重，含漱效果慢，不属于最佳治疗方案。